下列各项，属痰湿内阻头晕临床表现的是
A. 头晕胀痛
B. 头晕昏沉
C. 头晕眼花
D. 头晕耳鸣
E. 头晕欲仆

正确答案：B。头晕昏沉

解析：因痰湿内阻，清阳不升，故见头晕昏沉（B对）。头晕胀痛因肝阳亢逆，扰动清窍，阳亢生风所致（A错）。头晕眼花因气虚血少，不能上荣，脑府失养所致（C错）。头晕耳鸣因肾精不足，髓海不充，脑府失养所致（D错）。头晕欲仆因肝阳上亢，阴不制阳，阳亢化风所致（E错）